在配对设计差值的符号秩和检验中，绝对值等于3的差值有4个，它们是-3、-3、3、3。如果它们的位次为4、5、6、7，则第2个-3的秩次应为
A. -5.5
B. -5
C. 4
D. 5.5
E. 7

正确答案：A。-5.5